具有明显季节性的邪气是
A. 风
B. 寒
C. 暑
D. 燥
E. 火

正确答案：C。暑

解析：风为春季的主气。风邪引起的疾病以春季居多，但四季常有（A错）。寒为冬季的主气。寒邪常见于冬季，但在其他季节气温骤降，人体不注意防寒保暖等，也会感受寒邪（B错）。暑为夏季的主气，乃火热之气所化，故暑病即是热病，仅是季节上的分别而已，暑邪致病具有明显的季节性（C对）。燥为秋季的主气，燥邪伤人，多从口鼻而入，首犯肺卫，发为外燥病证。初秋尚有夏末余热，久晴无雨，秋阳以曝，燥与热合，侵犯人体，发为温燥，深秋近冬之寒气与燥相合，侵犯人体，则发为凉燥（D错）。火热旺于夏季，但并不像暑那样具有明显的季节性，也不受季节气候的限制，一年四季均可发生（E错）。